引起医院交叉感染最常见的细菌是
A. 伤寒沙门菌
B. 结核分枝杆菌
C. 耐药性金黄色葡萄球菌
D. 乙型溶血性链球菌
E. 变形杆菌

正确答案：C。耐药性金黄色葡萄球菌

解析：交叉感染或外源性感染：在医院内患者接受不洁的输血或注射或不规范的介入诊疗技术如导管、插管及内镜等，被微生物交叉感染，常见细菌为耐药性金黄色葡萄球菌。掌握“医院感染及细菌的致病性”知识点。